毛果芸香碱对眼的作用
A. 降低眼压，扩瞳，调节痉挛
B. 降低眼压，缩瞳，调节麻痹
C. 降低眼压，缩瞳，调节痉挛
D. 升高眼压，扩瞳，调节痉挛
E. 升髙眼压，缩瞳，调节痉挛

正确答案：C。降低眼压，缩瞳，调节痉挛

解析：毛果芸香碱是M受体激动剂，可直接激动虹膜瞳孔括约肌（受动眼神经的副交感纤维即胆碱能纤维调节）引起缩瞳（AD错）；缩瞳可使虹膜向中心拉动，虹膜根部变薄，使虹膜前房角间隙扩大，房水易于经滤帘进入巩膜静脉窦，使眼内压下降（DE错）。毛果芸香碱使环状肌收缩，造成悬韧带放松，晶状体由于其自身弹性变凸，屈光度增加，此时只适合视近物，而难以看清远物即调节痉挛作用。故毛果芸香碱对眼的作用表现为降低眼内压、缩瞳、调节痉挛（C对）。